以下药物属于广谱抗真菌药物的是
A. 氟康唑
B. 甲硝唑
C. 青霉素
D. 红霉素
E. 链霉素

正确答案：A。氟康唑

解析：氟康唑属于广谱抗真菌药。掌握“氟康唑、利巴韦林及阿昔洛韦”知识点。